双胍类降血糖药物的降糖作用机制为
A. 促进餐后胰岛素的分泌
B. 促进基础胰岛素的分泌
C. 延缓肠道碳水化合物的吸收
D. 激活过氧化物酶增殖体活化因子受体
E. 增加外周组织对葡萄糖的摄取和利用

正确答案：E。增加外周组织对葡萄糖的摄取和利用

解析：双胍类降血糖药物的降糖作用机制为抑制肝葡萄糖输出，改善外周组织对胰岛素的敏感性、增加对葡萄糖的摄取和利用而降低血糖（E对）。促进餐后胰岛素分泌（A错）主要为格列奈类的降糖作用机制，促进基础胰岛素分泌（B错）主要为磺酰脲类的降糖作用机制。延缓肠道碳水化合物的吸收（C错）为α葡萄糖苷酶抑制剂的降糖作用机制。